尤其适用于伴有精神症状的儿童癫痫患者的药物是
A. 苯妥英钠
B. 卡马西平
C. 丙戊酸钠
D. 乙琥胺
E. 氯硝西泮

正确答案：B。卡马西平